推动和调节脏腑气化的是
A. 肝
B. 心
C. 肺
D. 肾
E. 脾

正确答案：D。肾

解析：肾为先天之本，肾主藏精，指贮存、封藏精气以主司人体的生长发育、生殖的生理功能。肾精、肾气具有促进机体生长发育的作用，肾藏精，精化气，肾精足则肾气充，肾精亏则肾气衰。肾为脏腑之本，肾中精气阴阳对先天脏腑的生成和后天脏腑的功能具有重要的生理作用，因而能够推动和调节脏腑气化（D对）。肝的生理特性有肝主升发、肝喜条达而恶抑郁。肝的生理功能有肝主疏泄、肝主藏血（A错）。心的生理特性有心主通明、心火宜降。心的生理功能有心主血脉、心主神明（B错）。肺的生理特性有肺为华盖、肺为娇脏、肺气宣降、肺喜润恶燥。肺的生理功能有肺主气司呼吸、肺主通调水道、肺朝百脉（C错）。脾的生理特性有脾气宜升、脾喜燥恶湿。脾的生理功能有脾主运化、脾主统血（E错）。